关于糖浆剂的错误表述是
A. 糖浆剂系指含药物或芳香物质的浓蔗糖水溶液
B. 含蔗糖85%（g/g）的水溶液称为单糖浆
C. 低浓度的糖浆剂应添加防腐剂
D. 高浓度的糖浆剂可不添加防腐剂
E. 必要时可添加适量乙醇、甘油和其它多元醇作稳定剂

正确答案：B。含蔗糖85%（g/g）的水溶液称为单糖浆

解析：本题考查糖浆剂。含蔗糖85%（g/ml）或64.7%（g/g）的水溶液称为单糖浆（B错，为本题正确答案）。糖浆剂系指含药物或芳香物质的浓蔗糖水溶液（A对）；低浓度的糖浆剂应添加防腐剂（C对）；高浓度的糖浆剂可不添加防腐剂（D对）；必要时可加入适量乙醇、甘油或其它多元醇作稳定剂（E对）。